通过阻断AT₁受体而降低外周血管阻力的药物是
A. 卡托普利
B. 阿替洛尔
C. 哌唑嗪
D. 氯沙坦
E. 氢氯噻嗪

正确答案：D。氯沙坦

解析：本题考查氯沙坦。氯沙坦（D对）属于血管紧张素Ⅱ受体阻断剂（ARB），通过拮抗血管紧张素Ⅱ与AT₁结合，降低血压。卡托普利（A错）为血管紧张素转换酶抑制剂（ACEI），通过抑制血管紧张素Ⅰ转换成血管紧张素Ⅱ，扩张血管，降低血压。阿替洛尔（B错）为β₁受体阻滞剂。哌唑嗪（C错）能选择性阻滞血管平滑肌突触后膜α₁受体，同时舒张小动脉和小静脉，从而降低外周血管阻力，降低血压。氢氯噻嗪（E错）是一种中效利尿剂。